砂仁不具有的功效是
A. 化湿
B. 行气
C. 解暑
D. 温中
E. 安胎

正确答案：C。解暑

解析：本题考查的是砂仁的功效。砂仁不具有的功效是解暑（C错，为本题正确答案）。砂仁：功效】化湿（A对）行气（B对），温中（D对）止泻，安胎（E对）。解暑为广藿香的功效。广藿香：【功效】化湿，止呕，发表解暑。